下列哪项不是盖髓剂的作用
A. 有较强的渗透作用
B. 有消炎作用
C. 有腐蚀作用
D. 便于操作
E. 药效稳定，持久

正确答案：C。有腐蚀作用

解析：盖髓剂应具备的性能：有促进牙髓组织的修复再生能力。对牙髓组织无毒性和无刺激性。有较强的杀菌或抑菌作用。有较强的渗透作用。有消炎作用。药效稳定，持久。便于操作。掌握“盖髓术”知识点。